寻常疣的外治，应选用
A. 推疣法
B. 浸渍法
C. 针挑法
D. 挖除法
E. 结扎法

正确答案：A。推疣法

解析：寻常疣，中医称之为疣目，多发于儿童及青年，最初为一个针头大至绿豆大的疣状赘生物，呈半球形或多角形，突出表面，色灰白或污黄，表面蓬松枯槁，状如花蕾，粗糙而坚硬，以后体积渐次增大，发展成乳头状赘生物，此为原发性损害，称母瘊，此后由于自身接种，数目增多，一般为二三个多则十余个至数十个不等，好发于手背、手指，外治：推疣法、鸦胆子散敷贴法和荸荠摩擦法（A对）。浸渍法不属于疣的外治方法（B错）。针挑法适用于传染性软疣（C错）。挖除法适用于掌跖疣（D错）。结扎法适用于丝状疣（E错）。